兼具抑菌作用、抑制痛觉神经和刺激腺体分泌的鼻用制剂是
A. 复方薄荷脑滴鼻液
B. 异丙托溴铵吸入剂
C. 氟替卡松鼻喷剂
D. 鲑鱼降钙素鼻喷剂
E. 利巴韦林滴鼻液

正确答案：A。复方薄荷脑滴鼻液

解析：本题考查复方薄荷脑滴鼻液。鼻黏膜保护药复方薄荷脑滴鼻液（A对）（薄荷与樟脑等配成液状石蜡溶液）有抑菌作用、抑制痛觉神经和刺激腺体分泌。异丙托溴铵吸入剂（B错）适用于需要多种支气管扩张剂联合应用的病人，用于治疗气管阻塞性疾病有关的可逆性支气管痉挛。氟替卡松鼻喷剂（C错）用于预防和治疗季节性过敏性鼻炎（包括花粉症）及常年性过敏性鼻炎。鲑鱼降钙素鼻喷剂（D错）用于骨质疏松症。利巴韦林滴鼻液（E错）用于病毒引起的感染。